肌皮神经支配的肌肉是
A. 肱三头肌、肱二头肌
B. 肱二头肌、肱桡肌
C. 肱桡肌、肱三头肌
D. 肱三头肌、肱肌
E. 肱肌、肱二头肌

正确答案：E。肱肌、肱二头肌

解析：肱三头肌（ACD错）由桡神经支配。肌皮神经支配肱二头肌、喙肱肌和肱肌（E对）。